Fones刷牙法又称为
A. 水平颤动法
B. 旋转刷牙法
C. 圆弧刷牙法
D. 横刷法
E. 竖刷法

正确答案：C。圆弧刷牙法

解析：圆弧刷牙法，又称Fones刷牙法，这种方法最易为年幼儿童学习理解和掌握。掌握“自我口腔保健方法”知识点。